单纯性煤尘是指SiO₂含量
A. 在15%以下
B. 在10%以下
C. 在5%以下
D. 在3%以下
E. 在1%以下

正确答案：C。在5%以下

解析：本题考查单纯性煤尘的概念。当煤尘中的二氧化硅含量在5%以下（C对ABDE错）时，称为单纯性煤尘。